王某于2001年6月从某医科大学本科毕业后，同年7月分配到某县人民医院从事医生工作，2002年欲参加执业医师资格考试，考试由下列那一级部门组织实施
A. 国家卫生行政部门
B. 所在省的卫生行政部门
C. 所在市的卫生行政部门
D. 所在县的卫生行政部门
E. 所在医疗机构

正确答案：B。所在省的卫生行政部门